下列营养素吸收受植酸影响的是
A. 钠
B. 钙
C. 葡萄糖
D. 维生素B₁
E. 甘油三酯

正确答案：B。钙